络石藤的功效有
A. 散寒止痛
B. 祛风通络
C. 利水消肿
D. 凉血消肿
E. 化痰散结

正确答案：B、D。祛风通络；凉血消肿